儿童口腔不良习惯包括
A. 吮指
B. 吐舌
C. 口呼吸
D. 偏侧咀嚼
E. 以上说法均正确

正确答案：E。以上说法均正确

解析：戒除口腔不良习惯：3岁以上的儿童仍有吮指、咬下唇、吐舌、口呼吸、偏侧咀嚼等不良习惯，如果不能通过劝导方法戒除，应及时到医院就诊通过矫治帮助其尽早戒除。对有龋病儿童应及早治疗，避免单侧咀嚼。对有口呼吸习惯的儿童应检查其上呼吸道是否通畅，治疗扁桃体肿大、腺样体肥大、鼻甲肥厚等，以保证呼吸道的通畅，纠正口呼吸。掌握“学龄儿童口腔保健”知识点。